腺样囊性癌常发生远处转移的脏器是
A. 脑
B. 骨
C. 肝
D. 肾
E. 肺

正确答案：E。肺

解析：腺样囊性癌易侵入血管，造成血行性转移，转移率高达40%，为口腔颌面部恶性肿瘤中转移率最高的肿瘤之一。转移部位以肺最为多见。掌握“腺样囊性癌”知识点。